Ⅰ型超敏反应的发生机制分为
A. 两个阶段
B. 三个阶段
C. 四个阶段
D. 五个阶段
E. 六个阶段

正确答案：B。三个阶段

解析：Ⅰ型超敏反应的发生分为致敏、激发和效应三个阶段。掌握“概述及Ⅰ型超敏反应”知识点。